女性，16岁。因食过多桔子造成血中胡萝卜素增高，患者出现的皮肤粘膜黄染，首先常见于
A. 手掌、足底
B. 巩膜
C. 口腔粘膜
D. 躯干
E. 耳后

正确答案：A。手掌、足底

解析：胡萝卜素增高首先出现在手掌、足底、前额（A对）。黄疸常首先出现在巩膜，长期服用含有黄色素的药物常首先出现在皮肤。